组成药物中含有炮姜、川芎的方剂是
A. 生化汤
B. 温经汤
C. 血府逐瘀汤
D. 通窍活血汤
E. 身痛逐瘀汤

正确答案：A。生化汤

解析：该题考查生化汤的组成。生化汤功能养血祛瘀，温经止痛，由当归、川芎、桃仁、炮姜、甘草组成（A对）。记忆：生化汤宜产后服，归芎桃草酒炮姜。